患者男性，56岁。间断无痛全程肉眼血尿2个月，体检：肾区无叩痛，尿检红细胞充满/HP，静脉尿路造影示：右肾盂有充盈缺损，考虑该患者为
A. 肾结石
B. 肾结核
C. 肾盂肾炎
D. 肾细胞癌
E. 肾盂癌

正确答案：E。肾盂癌

解析：患者56岁男性（中老年男性为泌尿系肿瘤的高发人群），间断无痛全程肉眼血尿2个月（泌尿系肿瘤的常见症状），静脉尿路造影示：右肾盂有充盈缺损，考虑诊断为肾盂癌（E对）。肾结石（A错）主要表现为肾区疼痛、镜下血尿。肾结核（B错）典型临床表现为膀胱刺激症状伴终末血尿，可有低热、盗汗等结核中毒表现。肾盂肾炎（C错）主要表现为寒战、高热、尿频、尿急、尿痛及腰背疼痛，肉眼血尿少见。肾细胞癌（D错）典型表现为肉眼血尿、腰痛和腹部肿块，CT检查大多可以确诊。